女性，65岁，腹胀痛，腹泻、便秘交替月余，伴里急后重感，无鲜血便。体格检查：腹平软，未及包块，左锁骨上，腹股沟淋巴结未触及进一步检查应首先采用
A. 肛门指检、直肠镜检
B. 大便常规加涂片
C. 腹部B超
D. 腹部X线平片
E. 钡剂灌肠

正确答案：A。肛门指检、直肠镜检

解析：老年女性患者，腹胀痛、腹泻便秘交替月余（直肠癌常见症状），伴里急后重感（直肠刺激征的表现），结合患者病史、临床表现和相关检查，应诊断为直肠癌。国人直肠癌约70%为低位直肠癌，能在直肠指诊时触及，患者疑似直肠癌需首先进行肛门指诊，直肠镜检可直接观察直肠病变的范围和部位，故为明确诊断，进一步检查应采用患者需行肛门指检、直肠镜检（A对）。大便潜血检查（B错）适用于大规模普查的初筛手段，对该患者意义不大。钡剂灌肠（E错）是结肠癌的重要检查方法，对直肠癌的诊断意义不大。直肠肛管属空腔器官，气体较多，且周围部位结构复杂，不宜行腹部B超检查（C错）。